下列哪项描述符合多形性红斑的临床特征
A. 发病有季节性，秋冬季多见
B. 一般不伴有全身反应
C. 发病过程缓慢，常迁延不愈，无自限性
D. 病损特征为红斑、水肿、大疱、糜烂等
E. 口腔可出现病损，皮肤、眼、生殖器则无

正确答案：D。病损特征为红斑、水肿、大疱、糜烂等

解析：本题考查多形性红斑的临床特征。多形性红斑口腔病损分布广泛，好发于唇、颊、舌、腭等部位。病损区黏膜充血水肿，有时可见红斑及水疱，但疱很快破溃，故最常见的病变为大面积糜烂（D对）。多形性红斑发病急，有自限性和复发性（C错），常在春秋季节发病（A错）。临床表现分为轻型和重型两种情况，轻型一般无全身症状，病损只限于黏膜和皮肤（E错），无其他器官和系统的病变；重型常有严重的全身症状（B错），病损除黏膜和皮肤外，身体其他各腔孔也受累（E错）。